治疗子宫内膜修复延长湿热蕴结证，应首选
A. 清肝止淋汤
B. 二妙丸
C. 清经散
D. 两地汤
E. 固经丸

正确答案：E。固经丸

解析：固经丸主治湿热带下，子宫内膜修复延长湿热蕴结证（E对）。清肝止淋汤为湿热下注冲任的代表方（A错），可导致经期延长，经间期出血，带下，阴痒等症。清经散（C错）以清实热为主治妇人血热。两地汤（D错）以滋阴清热为主治虚热。二妙丸（B错）治湿热下注之足膝肿痛。